细菌与抗菌药物反复接触后对药物的敏感性降低甚至消失，这种特性称为
A. 耐受性
B. 依赖性
C. 耐药性
D. 成瘾性
E. 习惯性

正确答案：C。耐药性

解析：耐药性又称抗药性，是指细菌与抗菌药物反复接触后，对药物的敏感性降低甚至消失（C对）。耐受性指同一药物连续使用过程中，会出现药效逐渐减弱，需加大剂量才能产生相同的药效；但在停用一段时间后，机体仍可恢复原有的敏感性（A错）。一些药物长期使用后会产生依赖性。依赖性又分为精神依赖和躯体依赖，若患者对药物不仅产生精神依赖性，还有躯体依赖性，一旦停止给药，患者表现出精神和躯体生理功能紊乱的戒断症状，则称为成瘾性第十版药理学（BD错）。精神依赖性又叫习惯性（E错）。